以下哪种方法符合运用快速、简便的检验、检查或其他措施，在健康的人群中，发现那些表面健康，但可疑有病或有缺陷的人
A. 调查
B. 问卷
C. 咨询
D. 筛检
E. 测验

正确答案：D。筛检

解析：筛检是运用快速、简便的检验、检查或其他措施，在健康的人群中，发现那些表面健康，但可疑有病或有缺陷的人。掌握“流行病的诊断和筛检试验及疾病监测”知识点。